下列与金黄色葡萄球菌毒力有关的因素是
A. 形成血浆凝固酶的能力
B. 特异性细胞糖类的存在
C. 耐药性
D. 透明质酸酶
E. 磷酸酶活力

正确答案：A。形成血浆凝固酶的能力

解析：本题考查与金黄色葡萄球菌毒力有关的因素。金黄色葡萄球菌的毒力因子包括：①细菌的一些表面结构蛋白，如黏附素、荚膜、胞壁肽聚糖和SPA等；②毒素：细胞溶素（α、β、γ、δ）、杀白细胞素、表皮剥脱毒素、毒性休克综合征毒素-1、肠毒素等；③酶类：凝固酶（A对）和其他酶（纤维蛋白溶酶、耐热核酸酶、透明质酸酶、脂酶等）。